患者，男，58岁。口渴多饮，尿频量多，口舌干燥6个月，伴烦热多汗，舌边尖红，苔薄黄，脉滑数，其证是
A. 上消肺阴亏虚证
B. 下消气阴两虚证
C. 上消肺气不足证
D. 中消肺胃郁热证
E. 上消肺热津伤证

正确答案：E。上消肺热津伤证

解析：患者口渴多饮，尿频量多，病为“消渴”，消渴分上中下三消，上消以肺阴虚津伤症状为主，中消以胃阴虚为主，下消以肾阴虚为主，患者口渴多饮，口舌干燥6个月舌边尖红，苔薄黄，肺热津伤为主，为“上消 肺热津伤证”（E对）。治宜清热润肺，生津止渴，方选消渴方加减。